左上睑下垂，左眼内收及上下视受限，左曈孔散大，直接，间接对光反射均消失，病变部位是
A. 视神经
B. 展神经
C. 动眼神经
D. 三叉神经
E. 滑车神经

正确答案：C。动眼神经

解析：左上睑下垂，左眼内收及上下视受限，左曈孔散大，直接，间接对光反射均消失，病变部位是动眼神经（C对）。展神经（B错）完全性麻痹：因外直肌瘫痪，内直肌失去拮抗作用，患眼内斜视不能外展，出现复视（实用神经病学第四版P891）。滑车神经（E错）完全性麻痹：表现为上斜肌瘫痪。患眼向下及外展运动减弱，眼球偏斜多不明显，往往不易被发觉（实用神经病学第四版P891）。视神经（A错）损伤：可引起双侧或单侧视力丧失，瞳孔对光反射迟钝或消失，眼球转动时眼球后部牵引样疼痛。三叉神经（D错）麻痹：面部感觉减退，角膜反应迟钝和（或）伴有嚼肌、颞肌无力或萎缩。